男孩，2岁，发热，咳嗽4天，咳喘加重1天。查体：双肺可闻及散在中小水泡音。血白细胞10×10⁹/L，中性0.65，淋巴0.35。最可能的诊断是
A. 支气管炎
B. 支气管肺炎
C. 毛细支气管炎
D. 上呼吸道感染
E. 支气管哮喘

正确答案：B。支气管肺炎

解析：一般有发热、咳嗽、呼吸急促的症状，肺部听诊闻及中、细湿啰音和（或）胸部影像学有肺炎改变均可诊断为支气管肺炎，是儿童时期最常见的肺炎，2岁以内儿童多发。本病例最可能的诊断是支气管肺炎（B对）。支气管炎一般不发热或仅有低热、全身状况好，以咳嗽为主要症状，肺部闻及不固定的干湿啰音等，与本病例不符（A错）。毛细支气管炎主要表现为下呼吸道梗阻症状，以喘息、三凹征和气促为主要临床特点，与本病例不符（C错）。上呼吸道感染无啰音等肺部炎症表现，与本病例不符（D错）。支气管哮喘有反复发作性喘息、气促，发作时可闻及弥漫性哮鸣音等临床表现，与本病例不符（E错）。